用标准氯化钠溶液（10㎍Cl/ml），为使氯化物所显浑浊度，纳氏比色管中含氯（Cl）量的适宜范围是
A. 0.1～1㎍
B. 1～10㎍
C. 50～80㎍
D. 200～300㎍
E. 300～500㎍

正确答案：C。50～80㎍

解析：本题考查氯化物检查法。标准氯化钠溶液（1O㎍Cl/ml）为氯化钠水溶液。氯化物浓度以50ml中含50～80㎍（C对）的Cl为宜。此范围内氯化物所显浑浊度明显，便于比较。